黄连解毒汤中泻心火兼泻中焦火的是
A. 黄连
B. 黄芩
C. 黄柏
D. 栀子
E. 犀角

正确答案：A。黄连

解析：黄连解毒汤中泻心火兼泻中焦火的是黄连。黄连大苦大寒清泻君火（A对）。黄芩清上焦之火（B错）。黄柏泻下焦之火（C错）。栀子清泻三焦之火（D错）。黄连解毒汤中没有犀角（E错）。